右肾盂内1.3cm单发结石，静脉尿路造影显示右肾轻度积水，肾功能正常，首选治疗方法是
A. 体外冲击波碎石
B. 经皮肾镜碎石
C. 经输尿管镜碎石
D. 药物治疗
E. 肾盂切开取石

正确答案：A。体外冲击波碎石

解析：右肾盂内1.3cm单发结石，右肾轻度积水，提示该患者无远端尿路梗阻，肾功能正常，故首选的治疗方法是体外冲击波碎石（ESWL）（A对）。经皮肾镜碎石（P560）（B错）适用于鹿角结石、≥2cm的肾结石、有症状的肾盏或憩室内结石等。经输尿管镜碎石（P561）（C错）适用于中、下段输尿管结石。药物治疗（D错）适用于结石＜0.6cm、表面光滑、结石以下尿路无梗阻的患者。肾盂切开取石（E错）主要用于肾盂输尿管处梗阻合并肾盂结石患者，因创伤较大，目前已很少使用。